足月女婴，自然分娩。出生体重3公斤，娩出时Apgar评分4分，抢救10分钟后评分9分。出生后2小时出现凝视，哭声单调，继而全身抽搐，肌张力偏高，为控制惊厥，应首先采用
A. 肌注呋塞米
B. 肌注地塞米松
C. 静注甘露醇
D. 静注苯巴比妥钠
E. 肌注维生素K

正确答案：D。静注苯巴比妥钠

解析：新生儿缺血缺氧性脑病患儿出现惊厥提示脑功能障碍，应尽快控制惊厥，首选静注苯巴比妥（D对）。肌注呋塞米（A错）和静注甘露醇（C错）用于治疗脑水肿（P102）。